休克早期血流量基本不变的器官是
A. 心脏
B. 肝
C. 肾
D. 肺
E. 脾

正确答案：A。心脏

解析：休克早期即微循环缺血性缺氧期，心、脑微血管灌流量能稳定在一定水平。这种不同器官微循环反应的差异，导致了血液的重新分布，保证了心脏（A对BCDE错）、脑重要生命器官的血液供应。